女，19岁，视物成双3月余。查体：双眼睑略下垂，瞳孔等大，对光反射存在，右眼不能向上和外展运动，左眼不能内收和下视运动，双鼻唇沟对称，双颊鼓气良好，余脑神经无异常。四肢肌张力正常，肌力5级，腱反射对称，病理征未引出，共济运动正常。眼轮匝肌低频重复电刺激示电位衰减25%。最可能的诊断
A. 面神经炎
B. 重症肌无力
C. 周期性瘫痪
D. Fisher综合征
E. 吉兰-巴雷综合征

正确答案：B。重症肌无力

解析：患者女，19岁，视物成双3月余（提示复视）。查体：双眼睑略下垂，瞳孔等大，对光反射存在（提示瞳孔括约肌正常），右眼不能向上和外展运动，左眼不能内收和下视运动（提示双侧眼外肌麻痹），双鼻唇沟对称，双颊鼓气良好（提示面部肌肉、口咽未受累），余脑神经无异常。四肢肌张力正常，肌力5级，腱反射对称，病理征未引出，共济运动正常。眼轮匝肌低频重复电刺激示电位衰减25%（提示重复神经电刺激试验阳性），根据该患者的临床症状、体查及实验室检查，最可能的诊断为重症肌无力（B对）。面神经炎（A错）多表现为额纹消失、口角下垂、鼓腮漏气等面神经损伤症状，该患者症状仅累及眼外肌，无损伤面神经损害体征。周期性瘫痪（C错）是一组以反复发作的骨骼肌迟缓性瘫痪为特征的肌病，多不累及脑神经，且病程为反复发作，数小时至数日缓解，发作间歇期完全正常。Miller-Fisher综合征（D错）属于吉兰巴雷的一个分型，但症状表现不同于经典GBS，多以复视起病，以眼肌麻痹、共济失调和腱反射减弱为特征。经典的吉兰-巴雷综合征（E错）多数首发症状为肢体对称性肌无力，逐步累及躯干肌、脑神经，该患者未出现四肢肌力改变。